无尿是指
A. ＜100mL/24h
B. ＜200mL/24h
C. ＜400mL/24h
D. ＞800mL/24h
E. ＞1000mL/24h

正确答案：A。＜100mL/24h

解析：正常人每日尿量1000～1500mL；即使肾脏发挥最大浓缩功能，每日尿量至少需要有500～600mL。尿量＜100mL/d，为无尿（A对）； 尿量＜400mL/d，为少尿。